直接调节甲状腺素产生与分泌的激素是
A. 糖皮质激素
B. 促甲状腺激素
C. 甲状旁腺素
D. 降钙素
E. 甲状腺球蛋白

正确答案：B。促甲状腺激素

解析：对甲状腺素产生和分泌起直接作用只有促甲状腺激素（B对），而其他激素或代谢产物等都是通过影响改变机体的不同状态而间接调节或影响甲状腺素的产生与分泌。